Graves病甲亢甲状腺的特点是
A. 症状越严重甲状腺越大
B. 甲状腺质地较硬且有触痛
C. 用碘剂可使甲状腺变软
D. 甲状腺呈弥漫性对称性肿大
E. 大多为结节性甲状腺肿

正确答案：D。甲状腺呈弥漫性对称性肿大

解析：Graves病大多数患者有程度不等的甲状腺肿大，甲状腺呈弥漫性对称性肿大（D对），质地不等，随吞咽上下移动，无压痛，甲状腺上下极可触及震颤，闻及血管杂音。少数病例甲状腺可以不肿大，甲状腺肿大和甲状腺生长抗体关系密切，此种抗体对甲状腺功能亢进程度影响不大，因此甲状腺肿大程度与甲亢严重程度无相关性，即甲亢症状越严重，甲状腺不一定越肿大（A错）。甲状腺质地较硬且有触痛（B错）是亚急性甲状腺炎（P692）的典型表现。结节性甲状腺肿（E错）是甲状腺结节或甲状腺癌的典型表现（P695）。使用碘剂会使甲状腺变硬（C错），血流减少。